使用奎尼丁治疗心房纤颤时，常先用强心苷的原因是
A. 强心苷提高奎尼丁的血药浓度
B. 强心苷拮抗奎尼丁的血管扩张作用
C. 强心苷能抑制房室传导，从而控制心室率
D. 强心苷能促进房室传导，从而控制心室率
E. 强心苷拮抗奎尼丁对心脏的抑制作用

正确答案：C。强心苷能抑制房室传导，从而控制心室率

解析：但其抗胆碱作用可能加快房室结的传导，应用奎尼丁治疗心房纤颤和心房扑动时，可能出现心室率加快，故应用该药前可先用强心苷类药物减慢房室结的传导，以防心室率过快（C对）。